《金匮要略》论中风，邪在于经可见
A. 舌即难言
B. 即不识人
C. 肌肤不仁
D. 即重不胜
E. 口吐涎沫

正确答案：D。即重不胜

解析：从“邪在于络”至“口吐涎”止，主要论述中风在经、络、腑、脏的不同见症。中风所致的经脉痹阻，有轻有重。病变较轻者，邪中于络，营卫不能畅行于肌表，故肌肤麻痹不仁；病变较重者，邪中于经脉，以致气血不能运行于肢体，故沉重（D对）；病邪深入于腑，浊气蒙闭清窍，故昏不识人；心开窍于舌，诸脏经脉皆与舌相连。邪入于脏则心窍闭阻，故不能言语，口吐涎。